只受对侧大脑运动皮层支配的脑神经运动核为
A. 三叉神经运动核
B. 迷走神经背运动核
C. 疑核
D. 舌下神经核
E. 动眼神经核

正确答案：D。舌下神经核

解析：只受对侧大脑运动皮层支配的脑神经运动核为舌下神经（D对）和面神经核下部。三叉神经运动核（A错）、迷走神经背运动核（B错）、疑核（C错）、动眼神经核（E错）均受双侧大脑运动皮层支配。